女，25岁。停经7周，1h前突感下腹部疼痛，伴肛门坠胀感。査体：皮肤苍白，下腹压痛反跳痛腹肌紧张，阴道后穹窿饱满，有压痛。确诊后，正确处理措施为
A. 抗生素治疗
B. 抗结核治疗
C. 观察2天
D. 剖腹探查术
E. 雌激素治疗

正确答案：D。剖腹探查术

解析：育龄期女性，停经7周（输卵管妊娠常有6～8周的停经史），突发下腹痛，伴肛门坠胀感（典型症状为停经后腹痛与阴道流血，输卵管妊娠破裂时突感一侧下腹部撕裂样疼痛），皮肤苍白（输卵管妊娠破裂时疼痛和出血引起），下腹部压痛、反跳痛、腹肌紧张（腹部检查：下腹有明显压痛及反跳痛，尤以患侧为著，但腹肌紧张轻微），阴道后穹隆饱满，有压痛（输卵管妊娠流产或破裂者，阴道后穹隆饱满，有触痛），最可能的诊断是输卵管妊娠破裂出血，正确处理措施为行剖腹探查术（D对C错）以控制出血，切除病变，维持生命体征。抗生素治疗（A错）、抗结核治疗（B错）及雌激素治疗（E错）均对输卵管妊娠破裂出血没有治疗价值。